玉液汤的功用有
A. 止渴
B. 止遗
C. 止痢
D. 止泄
E. 止咳

正确答案：A。止渴

解析：本题考查玉液汤的功用。玉液汤为治燥剂，主治消渴，消渴的症状，口干而渴，饮水不解，小便数多，困倦气短。其功用为益气生津，固肾止渴（A对）。